以下有关骨化性纤维瘤的论述中，不正确的是
A. 常见于年轻人，多为单发性
B. 多见于下颌，女性多于男性
C. 生长较快，早期即有自觉症状
D. 肿瘤逐渐增大后，可引起面部畸形及牙移位
E. 发生上颌骨者可产生复视

正确答案：C。生长较快，早期即有自觉症状

解析：骨化性纤维瘤常见于年轻人，多为单发性，可发生于上、下颌骨，但以下颌较为多见。女性多于男性。此瘤生长缓慢，早期无自觉症状，不易被发现；肿瘤逐渐增大后，可造成颌骨膨胀肿大，引起面部畸形及牙移位。发生于上颌骨者，常波及颧骨，并可能波及上颌窦及腭部，使眼眶畸形，眼球突出或移位，甚或产生复视。下颌骨骨化性纤维瘤除引起面部畸形外，可导致咬合紊乱，有时可继发感染，伴发骨髓炎。掌握“骨化纤维瘤”知识点。